患者男，46岁，心胸阵作隐痛，疾走则发，胸闷气短，动则甚，心悸，倦怠无力，神疲懒言，易出汗，舌淡胖，苔薄白心电图示ST段压低，T波倒置。应首先考虑的诊断是
A. 心肌梗死，心气不足
B. 心肌梗死，心阴亏虚
C. 心绞痛，心气不足
D. 心绞痛，心阴亏虚
E. 心绞痛，心虚胆怯

正确答案：C。心绞痛，心气不足

解析：本题患者心胸阵作隐痛，疲乏等症以及心电图示ST段压低，T波倒置可诊断为心绞痛。心气不足，鼓动乏力，则心悸；心居胸中，心气亏虚，胸中宗气运转无力，则胸闷气短；心神失养，则神疲懒言；汗为心液，心气虚则肌表不固，则易出汗；气虚运血无力，气血不充，则舌淡胖，苔薄白（C对，AB错）。心阴亏虚，症状：心悸，心烦不宁、失眠、多梦，口燥咽干，形体消瘦，手足心热，午后潮热，盗汗，颧红，舌红少津，脉细数（D错）。心虚胆怯，常见的症状有心悸不宁，善惊易恐，少寐多梦，坐卧不安，或者是梦中易惊醒等（E错）。